对依他尼酸描述正确的有
A. 属于保钾利尿药
B. 使用时要注意补充电解质
C. 大量使用时会出现耳毒性
D. 含有α，β-不饱和酮结构，在水溶液中不稳定
E. 含有芳氧乙酸酯结构，易水解

正确答案：B、C、D、E。使用时要注意补充电解质；大量使用时会出现耳毒性；含有α，β-不饱和酮结构，在水溶液中不稳定；含有芳氧乙酸酯结构，易水解